经切牙孔穿出的神经、血管是
A. 腭前神经、血管
B. 腭中神经、血管
C. 腭后神经、血管
D. 鼻腭神经、血管
E. 以上都是

正确答案：D。鼻腭神经、血管

解析：切牙乳头（腭乳头）：位于腭中缝前端的黏膜隆起，其深面为切牙孔，鼻腭神经、血管经此孔穿出。掌握“腭、舌、舌下区的局部解剖”知识点。